某男，17岁。近日头晕耳鸣、咳嗽吐衄、痰多黄稠、咽膈不利、口渴心烦。证属肝火犯肺，宜选用的中成药是
A. 牛黄上清片
B. 黛蛤散
C. 芩连片
D. 龙胆泻肝丸
E. 一清颗粒

正确答案：B。黛蛤散

解析：本题考查黛蛤散的主治。证属肝火犯肺，宜选用的中成药是黛蛤散（B对）。黛蛤散【主治】肝火犯肺所致的头晕耳鸣、咳嗽吐衄、痰多黄稠、咽膈不利、口渴心烦。牛黄上清片（A错）【主治】热毒内盛、风火上攻所致的头痛眩晕、目赤耳鸣、咽喉肿痛、口舌生疮、牙龈肿痛、大便燥结。芩连片（C错）【主治】脏腑蕴热，头痛目赤，口鼻生疮，热痢腹痛，湿热带下，疮疖肿痛。龙胆泻肝丸（D错）【主治】肝胆湿热所致的头晕目赤、耳鸣耳聋、耳肿疼痛、胁痛口苦、尿赤涩痛、湿热带下。一清颗粒（E错）【主治】火毒血热所致的身热烦躁、目赤口疮、咽喉及牙龈肿痛、大便秘结、吐血、咯血、衄血、痔血；咽炎、扁桃体炎、牙龈炎见上述证候者。